患者于某因发热3日到县医院就诊，接诊医师林某检査后拟诊为流行性出血热。因县医院不具备隔离治疗条件，林某遂嘱患儿的家长带于某去市传染病医院就诊。按照传染病防治法的规定，林某应当
A. 请上级医师会诊，确诊后再转诊
B. 请上级医师会诊，确诊后隔离
C. 向医院领导报告，确诊后对于某就地进行隔离
D. 向当地疾病控制机构报告，并复印病历资料转诊
E. 向当地疾病控制机构报告，由疾病控制机构转诊

正确答案：D。向当地疾病控制机构报告，并复印病历资料转诊

解析：接诊医师林某检査后拟诊患者于某为流行性出血热，流行性出血热属于乙类传染病，而该县医院不具备隔离治疗条件。《传染病防治法》规定，任何单位和个人发现传染病病人或者疑似传染病病人时，应当及时向附近的疾病预防控制机构或者医疗机构报告。医疗机构不具备相应救治能力的，应当将患者及其病历记录复印件一并转至具备相应救治能力的医疗机构。林某应当及时向当地疾病控制机构报告，并复印病历资料转诊（D对）至具备相应救治能力的医疗机构。